龋病的好发部位是
A. 磨牙咬合面窝沟
B. 后牙邻接面
C. 前牙牙颈部
D. 窝沟、邻接面和牙颈部

正确答案：D。窝沟、邻接面和牙颈部

解析：本题考查龋病的好发部位。龋病的好发部位是窝沟、邻接面和牙颈部（D对）。磨牙咬合面窝沟、邻接面和牙颈部，不易清洁，是菌斑滞留区，易导致龋损的发生。